能产生严重过敏反应的物质是
A. 多巴胺
B. 去甲肾上腺素
C. 异丙肾上腺素
D. 5-羟色胺
E. 肾上腺素

正确答案：D。5-羟色胺

解析：5-羟色胺综合征是服用5-羟色胺能药物（如氯丙咪嗪、氟西汀、5-羟色胺酸等）或合用5-羟色胺能药物和单胺氧化酶抑制剂而引起的一组症状群。临床上典型病例较少见。其主要临床表现包括：精神状态和行为改变（轻躁狂、激越、意识混乱、定向障碍、酩酊状态）；运动系统功能改变（肌阵挛、肌强直、震颤、反射亢进、踝阵挛、共济失调）；植物神经功能紊乱（发热、恶心、腹泻、头痛、颤抖、脸红、出汗、心动过速、呼吸急促、血压改变、瞳孔散大）（D对）。